聚山梨酯80（Tween80）的亲水亲油平衡值（HLB值）为15，在药物制剂中可作为
A. 增溶剂
B. 乳化剂
C. 消泡剂
D. 消毒剂
E. 促吸收剂

正确答案：A、B、E。增溶剂；乳化剂；促吸收剂

解析：本题考查注射剂的附加剂。在药物制剂中，吐温常用作增溶剂（A对）、乳化剂（B对）或吸收促进剂（E对）。消泡剂（C错）是可消除泡沫的物质；常用的消毒剂（D错）及杀菌剂有阳离子和两性离子，少数阴离子表面活性剂。